某男性建筑工人，年龄37岁，长期使用各种振动工具搅拌水泥等工作。因手指麻木和感觉异常等症状而就诊。此工人可能患何种疾病
A. 局部振动病
B. 末梢神经炎
C. 风湿性关节炎
D. 周围神经炎
E. 骨关节病

正确答案：A。局部振动病

解析：本题考查局部振动病的概念。局部振动病（A对BCDE错）又称手臂振动病，是指长期从事手传振动作业而引起的以手部末梢循环障碍、手臂神经功能障碍为主的疾病，并可引起手、臂骨关节、肌肉的损伤。其典型表现为振动性白指，手臂振动病主要是由使用振动性工具引起。题中工人由于长期使用各种工具而引发的不适症状，属于局部振动病。